利用烤箱，将玻璃、陶瓷器皿加热至160～170℃，2小时，可达到
A. 消毒
B. 灭菌
C. 防腐
D. 无菌
E. 抑菌

正确答案：B。灭菌

解析：干烤法：为利用烤箱加热至160～170℃，2小时。适用于对耐高温的玻璃、陶瓷或金属器皿的灭菌。掌握“消毒与灭菌”知识点。